颌骨及颌弓的关系的检查包括
A. 上、下颌弓的水平位置关系
B. 上、下颌弓的垂直位置关系
C. 上、下颌弓的前后位置关系
D. 上、下颌弓的宽度
E. 以上都是

正确答案：E。以上都是

解析：本题考查颌骨及颌弓关系的检查。颌骨及颌弓关系检查包括：1.上、下颌弓的宽度（D对），查看形状和大小是否协调，上下颌吸收情况是否一致。如上下颌弓形状和大小相差较多时，会给排列人工牙造成困难。2.上下颌弓的位置关系，包括上、下颌弓的水平位置关系（A对）和上、下颌弓的垂直位置关系（B对）。水平关系即上、下颌弓的前后位置关系（C对）和左右位置关系。综上所述，以上均正确(E对，为本题正确答案）。